艾附暖宫丸既能暖宫调经，又能
A. 益气养血
B. 理气活血
C. 理气养血
D. 理气止痛
E. 理气疏肝

正确答案：C。理气养血

解析：本题考查的是艾附暖宫丸的功能。艾附暖宫丸既能暖宫调经，又能理气养血（C对）。艾附暖宫丸：【功能】理气养血，暖宫调经。八珍益母丸：【功能】益气养血（A错），活血调经。女金丸：【功能】益气养血，理气活血（B错），止痛。复方丹参片：【功能】活血化瘀，理气止痛（D错）。柴胡舒肝丸：【功能】疏肝理气（E错），消胀止痛。